与A型行为密切相关的心身疾病是
A. 肺癌
B. 冠心病
C. 糖尿病
D. 支气管哮喘
E. 十二指肠溃疡

正确答案：B。冠心病

解析：1959年美国心脏病学家Friedman和Rosenman在对冠心病患者的前瞻性和回顾性研究的基础上提出了“A型行为类型”的人，认为这种行为类型与冠心病有密切联系，故又称为“冠心病易患模式”。掌握“心身疾病”知识点。